下列针对可疑菌痢患者的检查项目，错误的是
A. 血常规检查
B. 大便常规检查
C. 大便细菌培养
D. 乙状结肠镜检查
E. 大便涂片找痢疾杆菌

正确答案：D。乙状结肠镜检查

解析：细菌性痢疾患者的实验室检查如下：1.血象急性期白细胞计数及中性粒细胞中等度升高；慢性期患者可有轻度贫血（A对）。2.粪便检査典型痢疾粪便中无粪质，量少，呈鲜红黏冻状，无臭味。镜检可见大脓细胞及红细胞，并有巨噬细胞（B对）。3.病原学检査粪便培养阳性是确诊的依据。取脓血部分及时送检和早期多次送检均有助于提髙细菌培养阳性率（C对）。粪便培养出痢疾杆菌即可确诊（E对）（D错，为本题正确答案）。